突发公共卫生事件是指下列哪类突然发生，造成或者可能造成社会公众健康损害的事件
A. 甲类或乙类传染病流行
B. 重大传染病疫情群体性、不明原因疾病、重大和职业中毒以及其他严重影响公众健康的事件
C. 环境污染
D. 寄生虫病疫情
E. 水灾地震等严重危害公众生命财产安全的自然灾害

正确答案：B。重大传染病疫情群体性、不明原因疾病、重大和职业中毒以及其他严重影响公众健康的事件

解析：突发公共卫生事件包括重大传染病疫情、群体性不明原因疾病、重大食物和职业中毒及其他严重影响公众健康的事件（B对）。甲类或乙类传染病流行（A错）及寄生虫病疫情（D错）均属于重大传染病疫情，环境污染（C错）及水灾地震等严重危害公众生命财产安全的自然灾害（E错）均属于其他严重影响公众健康的事件。